脑组织的实质性损伤
A. 脑震荡
B. 脑挫裂伤
C. 急性颅内血肿
D. 颅骨骨折
E. 脑脊液漏口腔颌面部邻近颅脑，颌面伤常伴发颅脑损伤

正确答案：B。脑挫裂伤

解析：脑挫裂伤是脑组织的实质性损伤，意识障碍取决于脑损伤的程度，神经系统体征取决于损伤部位。掌握“口腔颌面部创伤急救”知识点。